诊断类重症肌无力的重复电刺激必须具备
A. 低频刺激电位衰减25%，高频刺激电位幅度增加200%
B. 低频刺激电位衰减20%，高频刺激电位幅度增加150%
C. 低频刺激电位衰减15%，高频刺激电位幅度增加100%
D. 低频刺激电位衰减5%，高频刺激电位幅度增加25%
E. 低频刺激电位衰减10%，高频刺激电位幅度增加50%

正确答案：A。低频刺激电位衰减25%，高频刺激电位幅度增加200%

解析：类重症肌无力又称Lambert-Eaton肌无力综合征，为一组自身免疫性疾病，临床表现为四肢近端肌无力，需与重症肌无力鉴别。此病患者虽然活动后即感疲劳，但短暂用力收缩后肌力反而增强，持续收缩后又呈疲劳状态，脑神经支配的肌肉很少受累。重症肌无力典型改变为动作电位波幅第5波比第1波在低频刺激时递减10%以上或高频刺激时递减30%以上（P367），而类重症肌无力患者神经低频重复刺激时波幅变化不大，但高频重复刺激波幅增高可达200%以上（A对）。